苯二氮䓬类抗焦虑药物的主要作用是
A. 精神松弛
B. 肌肉松弛
C. 精神和肌肉都松弛
D. 阻断多巴胺受体
E. 阻断5－羟色胺受体

正确答案：A。精神松弛

解析：苯二氮䓬类抗焦虑药物的药理作用包括精神松弛和肌肉松弛，以精神松弛为主要作用，可以减轻或消除患者的焦虑不安、紧张、恐惧情绪等（A对）。阻断多巴胺受体和5-羟色胺受体是抗精神病药物的药理作用，苯二氮䓬类抗焦虑药物作用于γ-氨基丁酸（GABA）受体、苯二氮䓬受体和氯离子通道的复合物（DE错）。